正确描述嗅神经的是
A. 即嗅束
B. 起始于下鼻甲
C. 穿过筛板上的筛孔
D. 接受鼻腔粘膜的感觉
E. 构成嗅神经的神经元胞体在嗅球

正确答案：C。穿过筛板上的筛孔

解析：嗅神经为特殊内脏感觉神经，传导嗅觉冲动（D错）。嗅神经起始于鼻腔上部（并向上鼻甲（B错）及鼻中隔上部延伸）嗅黏膜内的嗅细胞（1级神经元）。嗅黏膜（E错）内的嗅细胞是双极神经元，其中枢突集合成嗅神经，穿过筛板的筛孔（C对）和硬脑膜达颅前窝，终止于嗅球（2级神经元）。嗅球发出纤维再经嗅束（A错）至外侧嗅纹而终止于嗅中枢，产生嗅觉。